对于念珠菌性口炎中慢性肥厚型的高龄患者，为了明确诊断有无异常增生，首选的诊断方法是
A. 唾液培养
B. 唾液及血清念珠菌抗体测定
C. 活体组织检查
D. 直接涂片镜检
E. 病损区黏膜出现珠光白色血CEA测定网纹伴充血

正确答案：C。活体组织检查

解析：本题考查慢性增殖型念珠菌病。对于念珠菌性口炎中慢性肥厚型的高龄患者，为了明确诊断有无异常增生，首选的诊断方法是活体组织检查（C对）。对于慢性或肥厚性损害可进行活检，将组织切片用PAS染色，镜下可见增生的口腔黏膜上皮细胞间有芽生孢子和菌丝。慢性增殖型念珠菌病又称慢性肥厚型念珠菌性口炎、念珠菌性白斑。多见于颊黏膜、舌背及腭部。由于菌丝深入到黏膜内，引起角化不全、棘层增厚、上皮增生、微脓肿形成以及固有层乳头的炎细胞浸润，而表层的假膜与上皮层附着紧密，不易脱落。组织学检查，可见到轻度到中度的上皮不典型增生，有人认为念珠菌性白斑有高于4%的恶变率，特别是高龄患者应提高警惕，争取早期活检，以明确诊断。